抗癫痫药包括
A. 丙戊酸钠
B. 扑米酮
C. 卡马西平
D. 苯妥英钠
E. 乙琥胺

正确答案：A、B、C、D、E。丙戊酸钠；扑米酮；卡马西平；苯妥英钠；乙琥胺